脊髓蛛网膜
A. 有丰富的血管和神经
B. 紧贴脊髓表面并深入其沟、裂之中
C. 厚而坚韧，由致密结缔组织构成
D. 与深面的软脊膜之间存在一腔隙为蛛网膜下隙
E. 是产生脑脊液的部位

正确答案：D。与深面的软脊膜之间存在一腔隙为蛛网膜下隙

解析：脊髓蛛网膜为半透明而无血管（A错）的薄膜（C错）。脊髓蛛网膜与深面的软脊膜之间存在一腔隙为蛛网膜下隙（D对B错），内含脑脊液。但脑脊液产生的部位为脑室脉络丛，而不是脊髓蛛网膜（E错）。